患者男，48岁，发作性胸痛1个月，遇劳则发，神疲乏力，气短懒言，心悸自汗，舌质暗淡胖有齿痕，苔薄白，脉缓弱，每次发作含硝酸甘油后缓解，治疗应首选的方剂是
A. 补阳还五汤
B. 右归丸
C. 左归丸
D. 血府逐瘀汤
E. 枳实薤白桂枝汤

正确答案：A。补阳还五汤

解析：患者为稳定型劳力性心绞痛，发作性胸痛1个月，遇体力活动加重，含服硝酸甘油后可缓解。气虚故见神疲乏力，气短懒言，心悸自汗；气虚血瘀故见舌质暗淡胖有齿痕，苔薄白，脉缓弱（A对）。心肾阳虚证治法：益气壮阳，温经止痛。方药：参附汤合右归丸加减（B错）。心肾阴虚证治法：滋阴益肾，养心安神。方药：左归丸加减（C错）。心血瘀阻证治法：活血化瘀，通脉止痛。方药：血府逐瘀汤加减。（D错）。阴寒凝滞证治法：辛温通阳，散寒止痛。方药：枳实薤白桂枝汤合当归四逆汤加减（E错）。